孕妇需要蛋白质的最高时期是
A. 孕1期
B. 孕2期
C. 孕3期
D. 孕中期
E. 孕晚期

正确答案：E。孕晚期

解析：孕早期基础代谢率稍下降，于孕中期渐增高，至孕晚期可增高15%～20%（P40）。相应的蛋白质需要量在孕中期（4～6个月）每日增加15g，孕晚期（E对）（7～9个月）是需要蛋白质的最高时期，每日增加25g。